与狼疮肾损害关系最密切的自身抗体是
A. 抗dsDNA抗体
B. 抗RNP抗体
C. 抗SSB抗体
D. 抗Sm抗体
E. 抗SSA抗体

正确答案：A。抗dsDNA抗体

解析：狼疮肾是系统性红斑狼疮（SLE）最常见的内脏损害，发生机制主要为免疫复合物形成与沉积。抗dsDNA抗体（A对）是诊断SLE的标记抗体之一，多出现在SLE的活动期，其滴度与疾病活动性密切相关，是与狼疮肾损害关系最密切的自身抗体。抗RNP抗体（B错）见于混合性结缔组织病（MCTD）；抗SSA抗体（P817）（E错）与SLE中出现光过敏、血管炎、皮损、白细胞减低、平滑肌受累、新生儿狼疮等相关；抗SSB抗体（P817）（C错）与抗SSA抗体相关联，与继发性干燥综合征有关。抗Sm抗体（P817）（D错）也是诊断SLE的标记抗体之一，有助于早期和不典型患者的诊断或回顾性诊断，但对疾病的活动性诊断不大。